慢性前列腺炎患者，头晕，精神不振，腰酸膝冷，阳痿，早泄，稍劳后即有白浊溢出，舌淡红，脉细。其证型是
A. 阴虚火旺
B. 湿热下注
C. 肾阳不足
D. 气血瘀滞
E. 中气下陷

正确答案：C。肾阳不足

解析：肾阳不足，阳虚不能鼓动精神，则精神不振。肾阳虚衰，不能温养筋骨、腰膝，则腰痠膝冷。肾阳为生殖的动力，肾阳虚弱，固摄失司，则阳痿、早泄。综上得出上述证型为肾阳虚证（C对）。前列腺炎阴虚火旺证（A错）多表现为腰膝酸软，头晕目眩，失眠多梦，五心烦热，遗精或血精，排尿或大便时有白浊，尿道不适。舌红少苔，脉细数。前列腺炎湿热下注证（B错）多表现为尿频、尿急、尿痛，尿道灼热感，排尿不利，尿末或大便时滴白，会阴、少腹、睾丸、腰骶坠胀疼痛。伴发热、恶寒、头身痛楚等。舌红，荅黄腻，脉弦滑或数。前列腺炎气滞血瘀证（D错）多表现为病程长，少腹、会阴、睾丸坠胀疼痛，感觉排尿不净。指诊前列腺压痛明显，质地不均匀，可触及结节。舌质暗或有瘀斑，苔薄白，脉弦滑。前列腺炎无中气下陷（E错）的证型。